适于小儿使用的抗生素是
A. 青霉素
B. 链霉素
C. 氯霉素
D. 新霉素
E. 四环素

正确答案：A。青霉素

解析：本题考查适合小儿的抗生素。适于小儿使用的抗生素是青霉素（A对）。大多数抗菌药物都能进入乳汁，但进入乳儿体内的药量很小，不会对乳儿产生严重危害。偶有过敏反应、腹泻等情况。青霉素类对乳儿安全。链霉素（B错）耳毒性和肾毒性较严重，对小儿可能具有潜在危害，不宜应用。氯霉素（C错）。氯霉素在乳汁中的浓度为血清中的一半，有明显骨髓抑制作用，可引起灰婴综合征，故哺乳期禁用。新霉素（D错）会引起严重的肾、耳毒性，不宜应用于小儿。四环素（E错）与钙盐形成络合物，伴随钙盐沉积于牙齿及骨骼中，致使儿童牙齿黄染，影响骨质发育。